出血性休克的早期表现除外的是
A. 轻度烦躁
B. 口渴
C. 呼吸浅快
D. 皮肤苍白
E. 心率减慢

正确答案：E。心率减慢

解析：出血性休克的早期表现为：轻度烦躁，口渴，呼吸浅快，心率加快，皮肤苍白。掌握“口腔颌面部创伤急救”知识点。